下列氨基酸在体内可以转化为γ-氨基丁酸（GABA）的是
A. 谷氨酸
B. 天冬氨酸
C. 苏氨酸
D. 色氨酸
E. 蛋氨酸

正确答案：A。谷氨酸

解析：在体内可以转化为γ-氨基丁酸（GABA）的是谷氨酸（A对）。天冬氨酸（B错）在体内参与嘌呤碱和嘧啶碱的合成。苏氨酸（C错）属于中性氨基酸，是体内必需氨基酸，用于蛋白质合成。色氨酸（D错）在体内可以转化为5-羟色胺、尼克酸。蛋氨酸（E错）即甲硫氨酸参与合成肌酸、磷酸肌酸等。